体重在一生中增长最快的时期为
A. 胎儿期
B. 胎儿早期
C. 青春期
D. 幼儿期
E. 胎儿后期

正确答案：E。胎儿后期

解析：本题考查体重增长的相关内容。我国2005年调查资料显示生后3～4月龄的婴儿体重约等于出生体重的2倍；12月龄时体重约为出生体重的3倍。故生后第一年（E对ABCD错）是生后体重增长最快的时期，为第一个生长高峰。生后第二年体重增加约2.5～3kg,，即2岁时体重约达出生体重的4倍（12～13kg）；2岁后至青春前期儿童体重增长减慢但较恒定，年增长值约为2～3kg。